为改善微循环最好采用下列哪项措施
A. 纠正酸中毒
B. 大量激素
C. 扩容和应用扩血管剂
D. 控制输液量和应用缩血管剂
E. 强心利尿

正确答案：C。扩容和应用扩血管剂

解析：本题考查休克。通过扩充血容量和应用血管扩张剂（C对），微循环障碍一般可以得到改善。